与狂犬病病毒感染和毒力相关的结构是
A. 脂蛋白包膜
B. 内基氏小体
C. 中介体
D. 中和抗体
E. gp和NP

正确答案：A。脂蛋白包膜

解析：狂犬病病毒是弹状病毒科狂犬病毒属中能引起急性脑组织病变的嗜神经病毒。病毒外形似子弹头状，病毒的脂蛋白包膜含有糖蛋白G刺突和M2膜蛋白。掌握“狂犬病、人乳头瘤病毒”知识点。